下列哪项指明了典型心绞痛胸痛的部位
A. 胸部左侧
B. 胸部右侧
C. 心尖部
D. 左肩背部
E. 胸骨体上段或中段的后方

正确答案：E。胸骨体上段或中段的后方

解析：心绞痛通常是在冠状动脉固定性严重狭窄基础上，由于心肌负荷的增加引起心肌急剧的、暂时的缺血缺氧的临床综合征，其特点是阵发性的前胸压榨性疼痛或憋闷感觉，主要位于胸骨体上段或中段的后方（E对），可放射至心前区和左上肢尺侧，常发生于劳力负荷增加时，持续数分钟，休息或用硝酸甘油疼痛可缓解。胸部左侧（A错）疼痛可见于左侧气胸，胸部右侧（B错）疼痛可见于右侧气胸。心尖部（C错）疼痛也可见于部分心绞痛患者，但不是心绞痛胸痛最典型的部位。左肩背部（D错）疼痛可见于肩周炎。